婚前医学检查的项目
A. 遗传性疾病、指定传染病、有关精神病
B. 遗传性疾病、传染病、精神病
C. 严重遗传性疾病、传染病、精神病
D. 严重遗传性疾病、传染病、有关精神病
E. 严重遗传性疾病、指定传染病、有关精神病

正确答案：E。严重遗传性疾病、指定传染病、有关精神病

解析：母婴保健法第八条规定，婚前医学检查的疾病包括：严重遗传性疾病；指定传染病（如艾滋病、淋病、梅毒、麻风病）；有关精神病（如精神分裂症、躁狂抑郁型精神病及其他重型精神病）（E对）。